覆盖肺尖上方的壁胸膜
A. 肺胸膜
B. 肋胸膜
C. 膈胸膜
D. 纵隔胸膜
E. 胸膜顶

正确答案：E。胸膜顶

解析：胸膜顶是覆盖于肺尖上方的壁胸膜（E对）。